从健康传播效果的层次看，以上表述属于最低层次效果的是
A. 不能经常吃新鲜蔬菜、水果
B. 经常参加步行、游泳、打太极拳、跳秧歌舞等健身活动
C. 反感他人在自己身边吸烟
D. 相信低钠盐有利于健康
E. 能指出酗酒对健康的危害

正确答案：E。能指出酗酒对健康的危害